中学教学楼中男生厕所大便器应
A. 每20人1个
B. 每25人1个
C. 每40人1个
D. 每50人1个
E. 每90人1个

正确答案：D。每50人1个